受精卵着床时间是
A. 6～7天
B. 7～8天
C. 8～9天
D. 9～10天
E. 10～11天

正确答案：A。6～7天

解析：本题为记忆性概念，受精卵着床时间是6～7天（A对）。受精后第4～5天，桑葚胚或早期胚泡进入子宫腔并继续分裂发育成晚期胚泡，进入子宫腔的胚泡会在宫腔内漂浮1～2天，此时透明带溶解、消失，然后经过定位、黏附和侵入三个过程，囊胚完全埋入子宫内膜且被内膜覆盖。